甲状腺滤泡旁细胞（又称C细胞）分泌的降钙素的作用
A. 促进细胞内的氧化作用
B. 维持糖、蛋白、脂肪正常的代谢
C. 促进机体的正常生长发育
D. 保持机体各系统器官的生理功能
E. 抑制骨骼的吸收

正确答案：E。抑制骨骼的吸收

解析：降钙素（CT）由甲状腺滤泡旁细胞即C细胞产生和分泌，其生物学作用是降低血钙和血磷。这种作用是通过降钙素对骨和肾脏的作用来实现的，对骨的作用是通过抑制破骨细胞的活性，减少其分泌，阻止其分化、增殖，从而抑制骨吸收（E对）和溶骨过程，减少Ca²⁺释放，对肾脏作用是抑制肾近端小管重吸收钙磷，增加其在尿中排出，实现降低血钙和血磷。